预防有机磷农药中毒最有效的措施是
A. 遵守安全操作规程
B. 加强个人防护
C. 体检并严格控制有禁忌证的工人参加作业
D. 服用阿托品药物预防
E. 及时发现病人，及时治疗

正确答案：A。遵守安全操作规程